某新生儿出生7天被确诊为化脓性脑膜炎，下述哪种是常见的致病菌
A. 脑膜炎奈瑟菌
B. 流感杆菌
C. 肺炎链球菌
D. 金黄色葡萄球菌
E. B族链球菌

正确答案：E。B族链球菌

解析：新生儿及出生2～3个月的化脓性脑膜炎，常见的病原体是大肠杆菌、B组溶血性链球菌。掌握“链球菌属”知识点。